左旋多巴的不良反应有
A. 嗜睡
B. 齿龈增生
C. 精神障碍
D. 运动障碍
E. 开关现象

正确答案：C、D、E。精神障碍；运动障碍；开关现象

解析：本题考查左旋多巴的不良反应。左旋多巴常见的不良反应有：①胃肠道反应，恶心，呕吐；②心血管反应，直立性低血压；③运动障碍（D对），另外还可出现“开关”现象（E对），患者突然多动不安（开），而后又出现全身性或肌强直性运动不能（关）；④精神障碍（C对），出现失眠、狂躁、幻觉、抑郁等。